男性，40岁，渔民。因发热1周伴腹痛、腹胀、腹泻，大便每日3~4次，稀便有黏冻，村卫生室给服氯霉素5天，患者热退，症状好转，继续工作，2周后再次发热，体温39℃，抽血培养有伤寒杆菌生长。通过治疗患者体温恢复正常，两次血培养（﹣），但lgG含量仍高，考虑为带菌状态，哪个器官隐藏病菌最多
A. 胆
B. 脾
C. 肝
D. 肠道淋巴结
E. 单核吞噬细胞系统

正确答案：A。胆